体细胞突变的不良后果中最受重视的是
A. 致癌
B. 致畸
C. 动脉硬化症
D. 衰老
E. 遗传病

正确答案：A。致癌